生理-心理-社会医学模式的提出者是
A. 哈特莱
B. 冯特
C. 卡尔
D. 希波克拉底
E. 恩格尔

正确答案：E。恩格尔